按目的五轮分属，肉轮是指
A. 白睛
B. 黑睛
C. 瞳仁
D. 眼胞
E. 目眦

正确答案：D。眼胞

解析：古时人们将目的不同部位分属于五脏，如《灵枢·大惑论》曰：“精之窠为眼，骨之精为瞳子，筋之精为黑眼，血之精为络，其窠气之精为白眼，肌肉之精为约束”后世医家据此而归纳为“五轮学说”。即瞳仁属肾，称为水轮（C错）；黑睛属肝，称为风轮（B错）；两眦血络属心，称为血轮（E错）；白睛属肺，称为气轮（A错）；眼睑属脾，称为肉轮（D对）。